下列哪项属于牙半切术的适应证
A. 下颌磨牙根分叉区Ⅲ度或Ⅳ度病变，局部的深牙周袋不能消除者
B. 患牙两个根周围有充分的支持骨，牙无明显松动
C. 下颌磨牙根分叉病变，其中一根受累，另一侧较健康，有支持骨，不松动，并能进行根管治疗
D. 牙周-牙髓联合病变，有一根明显受累，患牙可以进行彻底的根管治疗
E. 多根上颌磨牙的某一个或两个根牙周组织破坏严重，且有Ⅲ度或Ⅳ度根分叉病变

正确答案：C。下颌磨牙根分叉病变，其中一根受累，另一侧较健康，有支持骨，不松动，并能进行根管治疗

解析：牙半切术的适应证：①下颌磨牙根分叉病变，其中一根受累，另一侧较健康，有支持骨，不松动，并能进行根管治疗者；②需留作基牙的患牙，尤其当患牙为牙列最远端的牙时，保留半个牙可作为修复体的基牙，避免作单端修复体。掌握“根分叉病变”知识点。